上述选项可用阴阳对立制约说明的是
A. 寒极生热，热极生寒
B. 重阴必阳，重阳必阴
C. 阴阳相错，而变由生也
D. 动极者镇之以静
E. 阴在内，阳之守也

正确答案：D。动极者镇之以静

解析：阴阳互根的意义，在于阴阳始终处于统一体之中，每一方都以对方的存在作为自身存在的前提和条件，任何一方都不能脱离对方而单独存在（E错）。阴阳交感，指阴阳二气在运动中相互感应而交合的相互作用。阴阳交通相合，彼此交感相错，是宇宙万物赖以生成和变的根源，所谓“天地感而万物化生”（C错）。阴阳转化，指事物的阴阳属性，在一定条件下可以向其相反的方向转化，即属阳的事物可以转化为属阴的事物，属阴的事物可以转化为属阳的事物（AB错）。阴阳对立，指阴阳“一分为二”，即对待、相反的关系，是事物或现象固有的属性。阴阳对立制约的意义在于防止阴阳的任何一方不至于亢盛为害，以维持阴阳之间的协调平衡（D对）。